在病例对照研究中，选择哪一组病例最好
A. 现患病例
B. 新发病例
C. 死亡病例
D. 住院病例
E. 门诊病例

正确答案：B。新发病例